直立或坐位时胸膜腔的最低处
A. 肺下界
B. 膈穹
C. 肋纵隔隐窝
D. 肋隔隐窝
E. 纵隔隐窝

正确答案：D。肋隔隐窝

解析：直立或坐位时胸膜腔的最低处是肋隔隐窝（D对）。